急性心力衰竭时，下列哪项代偿方式不可能发生？
A. 心率加快
B. 心脏扩张，增加前负荷
C. 交感神经兴奋
D. 心肌肥大
E. 血液重新分配

正确答案：D。心肌肥大

解析：心力衰竭时，在神经-体液机制的调控下，机体对心衰的代偿反应分为心脏本身的代偿和心外代偿。心脏本身的代偿包括心率增快（A错）、心脏紧张源性扩张、心肌收缩性增强、心室重塑。前三者属于功能性调整，可以在急性心衰时发生。心率增快是因为心衰时心排血量减少，进而激活颈动脉窦、主动脉弓的压力感受器，使交感神经兴奋（C错）而造成的。心脏紧张源性扩张即心排血量减少使心室舒张期充盈压（前负荷）增加，心脏扩张（B错），而前负荷适度增加可使心肌收缩力增强以代偿。心肌肥大（D对）是心室重塑的一种表现，而心室重塑是慢性代偿性反应，在急性心衰时不可能发生。急性心衰时，交感神经的兴奋使外周血管选择性收缩，使全身血液重新分配（E错），属于心外代偿。